下述各肌中，哪一块既能屈膝关节又能屈踝关节（跖屈）
A. 腓肠肌
B. 比目鱼肌
C. 胫骨后肌
D. 趾长屈肌
E. 腓骨长肌

正确答案：A。腓肠肌

解析：腓肠肌（A对）既能屈膝关节又能屈踝关节（跖屈）；比目鱼肌（B错）屈踝关节和膝关节；胫骨后肌（C错）屈踝关节，使足内翻；趾长屈肌（D错）屈踝关节，屈第2～5趾；腓骨长肌（E错）屈踝关节（跖屈）和使足外翻。